新生儿败血症的特征性表现是
A. 精神欠佳
B. 体温不稳定
C. 哭声减弱
D. 黄疸退而复现
E. 食欲欠佳

正确答案：D。黄疸退而复现

解析：黄疸是败血症的特殊表现，有时是唯一表现，具体表现为黄疸迅速加重、消退延迟或退而复现（D对）。精神欠佳（A错）、体温不稳定（B错）、哭声减弱（C错）、食欲欠佳（E错）均不是新生儿败血症的特征性表现。